下列关于肾的描述，何者错误
A. 肾锥体的夹端伸向肾窦
B. 2~3个肾小盏合成1个肾大盏
C. 皮质深入锥体之间的部分称肾柱
D. 一侧肾共分为10个肾段
E. 肾皮质主要由肾小体和肾小管构成

正确答案：D。一侧肾共分为10个肾段

解析：肾实质分为肾皮质和肾髓质。肾皮质由肾小体与肾小管组成（E对），肾髓质由 15 ~20个呈圆锥形的底朝皮质、尖向肾窦（A对）的肾锥体构成，伸入肾锥体之间的肾皮质称肾柱（C对）。肾段为肾段动脉分布到一定区域的肾实质，由于肾动脉有5个分支，所以肾共有5个肾段（D错，为本题正确答案）。2 ~3个肾小盏合成 1个肾大盏（B对）。